引起血浆纤维蛋白原增高的疾病是
A. DIC
B. 原发性纤溶症
C. 重症肝炎
D. 肝硬化
E. 多发性骨髓瘤

正确答案：E。多发性骨髓瘤

解析：血浆纤维蛋白原增高见于缺血性心脑血管病如急性心肌梗死，应激状态如急性感染、休克、大手术、血栓前状态，以及急性肾炎、SLE、糖尿病、多发性骨髓瘤（E对）、妊娠高血压综合征、恶性肿瘤等，减低见于DIC、原发性纤溶症、重症肝炎、肝硬化等（ABCD错）。